以下哪项不是世界卫生组推荐的关于吸烟的“最划算”的干预措施
A. 提高税率
B. 烟草健康提示
C. 禁止烟草零售
D. 工作场所和公共场所室内禁止吸烟
E. 禁止烟草广告、促销和赞助

正确答案：C。禁止烟草零售